男，35岁。干咳伴低热1个月，痰中带血2天。体温37.5~38℃，咳少量鲜红色血丝痰。胸部CT：左上肺可见增殖、纤维灶，少量渗出阴影。PPD试验强阳性。该患者肺部组织损伤机制属于
A. Ⅰ型超敏反应
B. Ⅱ型超敏反应
C. Ⅲ型超敏反应
D. Ⅳ型超敏反应
E. 自身免疫反应

正确答案：D。Ⅳ型超敏反应

解析：患者青壮年男性，干咳，低热，痰中带血。胸部CT示左上肺增殖、纤维灶，少量渗出阴影。PPD试验强阳性。考虑诊断为肺结核。肺结核的肺部组织损伤机制属于Ⅳ型超敏反应（D对），发生较慢，亦称迟发型超敏反应。